常用的水溶性栓剂基质包括
A. 聚乙二醇类
B. 可可豆脂
C. 半合成脂肪酸酯
D. 甘油明胶
E. 泊洛沙姆

正确答案：A、D、E。聚乙二醇类；甘油明胶；泊洛沙姆

解析：本题考查栓剂的基质。聚乙二醇类（A对）、甘油明胶（D对）、泊洛沙姆（E对）为常用的水溶性栓剂基质；可可豆脂（B错）、半合成脂肪酸酯（C错）为油溶性基质。